能为制定意外伤害的预防策略和措施提供依据的是
A. 法律对策
B. 安全教育
C. 伤害监测
D. 社区康复
E. 主动和被动干预

正确答案：C。伤害监测